表示儿童体重资料的平均水平最常用的指标是
A. 算术平均数
B. 中位数
C. 几何均数
D. 变异系数
E. 百分位数

正确答案：A。算术平均数

解析：本题考查算数均数的相关内容。算数均数是一个变量所有观测值的和除以观测值的个数，反映一个变量所有观测值的平均水平，简称为均数（A对BCDE错）。